腹部闭合性损伤中最易损伤的实质性器官是
A. 肝脏
B. 脾脏
C. 胰腺
D. 肾脏
E. 肾上腺

正确答案：B。脾脏

解析：腹部闭合性损伤中最常见的是脾脏损伤（B对），约占20%～40%，其次为肾（D错）、小肠、肝（A错）、肠系膜等损伤。胰腺（C错）由于解剖位置较深，较少发生损伤，其损伤约占腹部损伤的1%～2%；肾上腺（E错）位置深在，较少发生损伤。腹部开放性损伤中最常见的是肝脏损伤，约占37%，其次为小肠、胃、结肠、大血管等损伤。此外，腹部损伤最常见的是脾脏损伤，约占40％～50％。